常用的风险评价方法不包括
A. 风险矩阵法
B. 风险度评价
C. 核查表评价
D. 直方图评价
E. 主观评价

正确答案：E。主观评价

解析：本题考查常用的风险评价方法。风险评价是指在风险识别和风险分析的基础上，将风险与给定的风险准则比较，以确定风险的严重程度并做出决策。常用的风险评价方法包括：风险矩阵法（A对），风险度评价（B对），核查表评价（C对）和直方图评价（D对）等。主观评价（E错，为本题正确答案）不是常用的风险评价方法。